患者女，孕后腰酸腹痛，胎动下坠，无阴道出血，可诊断为
A. 妊娠胞阻
B. 儿枕痛
C. 胎动不安
D. 妊娠腰痛
E. 胎死不下

正确答案：C。胎动不安

解析：患者孕后腰酸腹痛，胎动下坠，无阴道出血，可诊断为胎动不安（C对）。胞阻是指女性妊娠期间，出现以小腹疼痛为主的病证（A错）。产妇分娩后，子宫阵发性收缩而小腹疼痛者，称产后腹痛。本病多见于经产妇，中医学称为“产后腹痛”；因瘀血所致者又称“儿枕痛”（B错）。妊娠期间出现以腰痛为主症者，称为“妊娠腰痛”（D错）。稽留流产指胚胎或胎儿已死亡，滞留在宫腔内未及时自然排出者，又称过期流产中医学称为“胎死不下”（E错）。